香豆素类过量出血可选用
A. 维生素B₁₂
B. 鱼精蛋白
C. 维生素C
D. 维生素K
E. 氨甲苯酸

正确答案：D。维生素K